高血压性心脏病左心室增大，其心脏浊音界呈
A. 靴形
B. 梨形
C. 烧瓶形
D. 普大型
E. 心腰部凸出

正确答案：A。靴形

解析：高血压性心脏病左心室增大，心浊音界向左下增大，心腰加深，心界似靴形（A对）。梨形心及心腰部凸出见于左房与肺动脉段均增大（BE错）。烧瓶形心见于心包积液（C错）。普大型心见于左、右心室增大（D错）。